男，40岁，因大量蛋白尿，高度浮肿，诊断肾病综合征入院。肾穿活检病理为：“微小病变型”。即予泼尼松60mg/日口服，症状有所控制。治疗3周后，又出现大量蛋白尿，双下肢浮肿加重，肾功能减退。此时首先应考虑
A. 感染
B. 肾静脉血栓形成
C. 加用细胞毒药物
D. 糖皮质激素冲击
E. 急性肾衰竭

正确答案：B。肾静脉血栓形成

解析：该患者已诊断为肾病综合征，肾穿活检病理为：“微小病变型”（即脂性肾病，多见于儿童，肾脏病变较轻，预后良好，较少发展为急性肾衰竭），使用激素后症状缓解，治疗3周后又出现大量蛋白尿，双下肢浮肿加重，肾功能减退。推测最有可能并发症应为肾静脉血栓形成（B对）。肾静脉血栓属于肾病综合征常见并发症，主要症状为突然出现的不明原因的的腰痛、大量血尿、大量蛋白尿以及急性肾损伤。感染（A错）也是肾病综合征的常见并发症，但是本患者未表现发热，白细胞升高等常见感染征象，因此不作为首选诊断。细胞毒性药物（C错）多用于激素治疗无效，或激素依赖型或反复发作型的患者，本患者使用激素治疗即出现好转，表明激素敏感，故一般不会加用细胞毒性药物。冲击治疗（D错）较常见于于急进性肾炎的治疗，肾病综合征多需长期使用激素治疗，而不用冲击疗法。急性肾衰竭（E错）较少见于肾病综合征患者，常出现少尿症状，本患者并未明确提示少尿，所以不作为首选诊断。